男，48岁，吸烟。近日得知一名吸烟朋友患肺癌后，有些害怕，想戒烟，但又心存侥幸觉得不会那么巧吧，吸烟的人有的是，怎么就自己会得肺癌？同时也担心戒烟会导致发胖，对戒烟缺乏信心。针对这种情况，健康教育工作者运用的行为干预理论是
A. 知-信-行理论模式
B. 价值期望理论模式
C. 强化理论模式
D. 健康信念模式
E. 行为转变阶段理论模式

正确答案：D。健康信念模式